双下肢对称性紫癜伴荨麻疹者常见于
A. 过敏性紫癜
B. 再生障碍性贫血
C. 激素性紫癜
D. 血小板减少
E. 特发性血小板增多症

正确答案：A。过敏性紫癜

解析：双下肢对称性紫癜伴荨麻疹者常见于过敏性紫癜（A对），过敏性紫癜为常见的血管变态反应性疾病，表现为反复发生的对称性紫癜，以下肢多见，可同时伴有荨麻疹、皮肤水肿等过敏表现。再生障碍性贫血（P548）（B错）可有出血，皮肤出血可表现为出血点或大片瘀斑，且无荨麻疹表现；激素性紫癜（C错）、血小板减少（D错）可有皮肤出血表现为瘀点、瘀斑、紫癜，但不伴荨麻疹表现；特发性血小板增多症（E错）少有皮肤瘀斑、紫癜，无荨麻疹。